女，62岁，尿频，尿急，尿痛1天，尿中可见血丝，伴排尿时下腹痛，无发热，不宜采取的检查方法是
A. 尿菌落计数
B. 尿细菌培养+药物敏感试验
C. 静脉尿路造影
D. 膀胱镜检查
E. 尿常规检查

正确答案：D。膀胱镜检查

解析：患者女，62岁，突然发病，有尿频、尿急、尿痛（急性膀胱炎尿路刺激症状），伴有血尿，伴排尿时下腹痛，不伴发热，结合患者的临床表现、典型体征，该患者考虑诊断为急性膀胱炎，可行尿常规检查（E对）、尿菌落计数（A对）、尿细菌培养及药物敏感试验（B对），在急性感染期禁忌作膀胱镜检查（D错，为本题正确答案）及尿道扩张，静脉尿路造影（C对）能了解肾脏、输尿、膀胱的形态、位置，尿路是否有功能性或器质性异常，还可以判断肾脏的排泄功能，对鉴别肾盂肾炎、肾结核、肾肿瘤、反复泌尿系统感染有一定的意义。